用于衡量柱效的参数是
A. 色谱峰高或峰面积
B. 死时间
C. 色谱峰保留时间
D. 色谱峰宽
E. 色谱基线

正确答案：D。色谱峰宽

解析：本题考查色谱法。用于衡量柱效的参数是色谱峰宽（D对）。色谱峰宽定义为通过色谱峰两侧的拐点作切线，在基线上的截距，主要用于柱效的评价。峰高定义为组分色谱峰顶点至时间轴的垂直距离；峰面积定义为色谱峰与基线间包围的面积，两者可用于定量参数（A错）。死时间（B错）定义为不被固定相保留的组分从进样到其在柱后出现浓度极大时的时间间隔。保留时间（C错）定义为由进样到某组分色谱峰峰顶的时间间隔，相同物质在相同的条件下，保留时间一致，故保留时间可作为定性参数。基线（E错）是指仅有流动相通过检测器时，所得到的流出曲线。